某男，70岁。冠心病史7年。常感胸痛隐隐，神疲乏力，气短懒言，心悸自汗，舌淡暗苔白，脉弱。根据应采取的治法，不宜选用的中成药是
A. 麝香保心丸
B. 通心络胶囊
C. 芪参胶囊
D. 舒心口服液
E. 参芍片

正确答案：A、B、C、D、E。麝香保心丸；通心络胶囊；芪参胶囊；舒心口服液；参芍片

解析：本题考查的是胸痹的辨证论治。冠心病史7年。常感胸痛隐隐，神疲乏力，气短懒言，心悸自汗，舌淡暗苔白，脉弱。根据应采取的治法，应选用的中成药芪参益气滴丸、参桂胶囊、心力丸、活心丸（ABCDE错，为本题正确答案）。胸痹气虚血瘀证：【症状】胸痛隐隐，遇劳则发，神疲乏力，气短懒言，心悸自汗。舌胖有齿痕，色淡暗，苔薄白，脉弱而涩，或结、代。【中成药应用】常用中成药有芪参益气滴丸、参桂胶囊、心力丸、活心丸。